氯丙嗪临床不用于
A. 甲状腺危象的辅助治疗
B. 精神分裂症或躁狂症
C. 晕动病引起呕吐
D. 加强镇痛药的作用
E. 人工冬眠疗法

正确答案：C。晕动病引起呕吐

解析：晕动病引起呕吐是由于前庭刺激引起的，而氯丙嗪镇吐的作用机制是拮抗延髓第四脑室底部的催吐化学感受区的受体（小剂量）或直接抑制呕吐中枢（大剂量）的结果，所以氯丙嗪临床不用于晕动病引起地呕吐（C错，为本题正确答案），晕动症应用抗组胺药止吐。人工冬眠疗法是氯丙嗪与其他中枢抑制剂（哌替啶、异丙嗪）合用，使患者深睡，体温、基础代谢率、组织耗氧量降低，增强患者对氧的耐受力，减轻机体对伤害性刺激的反应并使自主神经传导阻滞及中枢神经系统反应性降低，机体的这种状态有利于机体度过危险的缺氧缺能阶段（E对）。人工冬眠多用于严重创伤、感染性休克、高热惊厥、中枢性高热及甲状腺危象（A对）等病症的辅助治疗。氯丙嗪对Ⅰ型精神分裂症（阳性症状为主）或躁狂症效果显著（B对）。氯丙嗪可加强镇痛药的作用（D对）。